女，67岁。阵发性心房颤动1年，持续心悸2天，既往无高血压病史。2小时前急诊查体：BP110/60mmHg，心率130次/分，心律绝对不齐，心音强弱不等。予以普罗帕酮静脉推注后，心悸缓解离院。1小时前因左腹痛再次就诊，无呕吐和腹泻。尿常规正常。该患者腹痛首先考虑的病因是
A. 肝淤血
B. 肾结石
C. 内脏动脉栓塞
D. 急性下壁心肌梗死
E. 主动脉夹层

正确答案：C。内脏动脉栓塞

解析：老年女性患者，阵发性心房颤动1年，持续心悸2天。2小时前急诊查体：BP110/60mmHg（正常值90～120/60～80mmHg），心率130次/分（正常60～100次/分），心律绝对不齐，心音强弱不等（房颤典型表现）。该患者发生房颤超过24小时，在没有抗凝的情况下予以普罗帕酮复律，1小时后因左腹痛再次就诊，患者发生房颤超过24小时（房颤持续不超过24小时，复律前则无需抗凝）必须在复律前用华法林抗凝3周，心律转复后需再用华法林抗凝3～4周（可记忆为前3后4）。结合患者症状、体征和病史，考虑该患者很可能发生心房栓子脱落致内脏血管栓塞（C对）。肝淤血（A错）常有肝脏肿大，呕吐，食欲不佳等表现。肾结石（B错）常表现为腰痛，出现血尿等泌尿系统症状。急性下壁心肌梗死（D错）主要表现为突发胸骨后压榨性疼痛、气喘、大汗淋漓等。主动脉夹层（E错）（P324）主要表现为突发前胸或胸背部持续性、撕裂样或刀割样剧痛，可放射到肩背部，且常伴高血压。